某个脏器的湿重与单位体重的比值为
A. 食物利用率
B. 脏器系数
C. 病理学检查
D. 一般性指标
E. 特异性指标

正确答案：B。脏器系数